可导致面垢、眵多的病邪是
A. 风邪
B. 暑邪
C. 湿邪
D. 寒邪
E. 火邪

正确答案：C。湿邪

解析：湿为阴邪，其性重浊、黏滞，易伤阳气，易阻气机。关于湿邪重浊的特点，其湿浊在上，则面垢、眵多（C对）；湿浊在下，则小便浑浊或滞涩不利、妇女白带过多；湿滞大肠，则大便溏泄、下痢脓血；湿邪浸淫肌肤，则可见湿疹浸淫流水等。风为阳邪，轻扬开泄，易袭阳位，风性善行而数变（A错）。暑为阳邪，其性炎热，暑性升散，易扰心神，伤津耗气，暑多挟湿（B错）。寒为阴邪，易伤阳气，寒性凝滞主痛，寒性收引（D错）。火热为阳邪，其性炎上，火热易扰神、伤津耗气、生风动血，火邪易致疮痈（E错）。